可改善生物碱薄层色谱展开效果的溶剂是
A. 冰醋酸
B. 甲酸
C. 苯甲酸
D. 三氟乙酸
E. 二乙胺

正确答案：E。二乙胺

解析：本题考查的是可改善生物碱薄层色谱展开效果的溶剂。可改善生物碱薄层色谱展开效果的溶剂是二乙胺（E对）。硅胶吸附色谱法和氧化铝吸附色谱法可以用于柱色谱吸附分离和薄层色谱分离。添加溶剂的选择时，为避免发生化学吸附，酸性物质宜用硅胶，碱性物质则宜用氧化铝进行分离。当然，硅胶、氧化铝用适当方法处理成中性时，情况会有所缓解。通常在分离酸性（或碱性）物质时，洗脱溶剂中分别加入适量乙酸（或氨、吡啶、二乙胺），常可达到防止拖尾、促进分离的效果。